需要执业药师向患者作特别提示的是
A. 当患者购买贵重药品时
B. 当患者购买非处方药时
C. 当患者购买近期调价的药品时
D. 当患者购买需特殊贮存的药品时
E. 当患者购买有效期内的药品时

正确答案：D。当患者购买需特殊贮存的药品时

解析：本题考查的是需特别提示的特殊情况。需要执业药师向患者作特别提示的是当患者购买需特殊贮存的药品时（D对）。执业药师需特别提示的特殊情况：（1）患者同时使用2种或2种以上含同一成分的药品时；或合并用药较多时。（2）当患者用药后出现不良反应时；或既往曾发生过不良反应事件。（3）当患者依从性不好时；或患者认为疗效不理想，或剂量不足以有效时。（4）病情需要，处方中配药剂量超过规定剂量时（需医师双签字）。处方中用法用量与说明书不一致，或非药品说明书中所指示的用法、用量、适应证时。（5）超越说明书范围的适应证或超过说明书范围的使用剂量（需医师双签字确认）。（6）患者正在使用的药物中有配伍禁忌或配伍不当时（如有明显配伍禁忌时应第一时间联系该医师以避免纠纷的发生）。（7）第一次使用该药的患者。（8）近期药品说明书有修改（如商品名、适应证、剂量、有效期、贮存条件、药品不良反应）。（9）患者所用的药品近期发现严重或罕见的不良反应。（10）使用含有毒中药或有毒成分药品的患者。（11）同一种药品有多种适应证或用药剂量范围较大或剂量接近阈值时。（12）药品被重新分装，而包装的标识不清晰时。（13）使用需特殊贮存条件的药品时；或使用临近有效期药品时。